不得在大众媒介发布广告的是
A. 乙类非处方药
B. 甲类非处方药
C. 处方药
D. “双跨”药品

正确答案：C。处方药

解析：本题考查的是“双跨”药品的广告管理。不得在大众媒介发布广告的是处方药（C对）。“双跨”药品（D错）的广告管理：“双跨”药品作为“处方药”时不得在大众媒介上发布广告或者以其他方式进行以公众为对象的广告宣传，作为“非处方药”（AB错）则可以在大众媒介上进行广告宣传。因此，“双跨”药品在大众媒体发布广告，进行适应症、功能主治或疗效方面的宣传，其宣传内容不得超出其非处方药适应症（或功能主治）范围。